男，45岁，酗酒后8小时出现中上腹疼痛，放射至两侧腰部，伴恶心呕吐。体检腹部有压痛、肌紧张及两侧腰腹部出现蓝棕色斑，血压75/55mmHg，脉搏110次/分。下列检查应首先选择
A. 血尿常规
B. 尿淀粉酶测定
C. 胸腹部X线平片
D. 血清淀粉酶测定
E. 腹部B型超声检查

正确答案：D。血清淀粉酶测定

解析：患者酗酒后8小时出现中上腹疼痛，放射至两侧腰部，伴恶心呕吐，且两侧腰腹部出现蓝棕色斑即Grey-Turner征，为急性重型胰腺炎的特征性表现，故患者考虑诊断为急性重型胰腺炎。患者发病8小时，血淀粉酶于起病后2～12小时开始增高，故为明确诊断，首选的检查是血淀粉酶（D对）。血尿常规主要用于急、慢性感染、泌尿系疾病等的检查，而不用于急性胰腺炎的检查（A错）。尿淀粉酶与胰腺炎起病后12～24小时开始升高，故患者发病8小时，尿淀粉酶还未升高（B错）。腹部平片（C错）不用于急性胰腺炎的辅助检查，常用于诊断消化道穿孔、肠梗阻、骨折等疾病的辅助检查。腹部B超（E错）虽对急性胰腺炎诊断有一定价值，但易受胃肠气体干扰，故不常用于急性胰腺炎的诊断。